哌替啶作为吗啡代用品用于各种剧痛是因为
A. 镇痛作用比吗啡强
B. 成瘾性较吗啡弱
C. 不引起体位性低血压
D. 作用时间较吗啡长
E. 便秘的副作用轻

正确答案：B。成瘾性较吗啡弱